关于右心室的叙述,正确的是
A. 形成心尖的大部分
B. 按水平面来说，位于右心房的前方
C. 室壁比左心室壁明显的厚
D. 内壁全部呈现肉柱形嵴状
E. 有冠状窦开口

正确答案：B。按水平面来说，位于右心房的前方

解析：按水平面来说，右心室位于右心房的前方（B对），位于胸骨左缘第4-5肋软骨的后方。